莫西沙星可能导致的典型不良反应有
A. 跟腱炎、跟腱断裂
B. 视网膜脱落
C. 尖端扭转性室性心律失常
D. 幻觉、失眠
E. 光敏性皮炎

正确答案：A、C、D、E。跟腱炎、跟腱断裂；尖端扭转性室性心律失常；幻觉、失眠；光敏性皮炎

解析：本题考查莫西沙星的不良反应。莫西沙星属于氟喹诺酮类抗菌药物，不良反应包括跟腱炎症、跟腱断裂（A对）、心脏毒性（C对）、双相血糖紊乱、光毒性（E对）、精神神经系统不良反应。严重的精神神经系统不良反应包括抑郁、 幻视（D对）等。视网膜脱落（B错）不是其不良反应。